男，8岁。2天前因“感冒”诱发咳嗽，口服糖皮质激素无缓解。3岁至8岁类似喘息发作10余次，曾查肺功能明显降低，支气管舒张试验阳性。查体：呼吸困难，大汗淋漓，不能平卧，面色青灰，三凹征，双肺呼吸音降低，无哮鸣音，心音较低钝。此时不适合的治疗是
A. 使用吸入型速效β₂受体激动剂
B. 必要时辅以机械通气
C. 使用吸入型糖皮质激素
D. 氧疗
E. 补液、纠正酸中毒

正确答案：C。使用吸入型糖皮质激素

解析：患者儿童，有感冒病史，多次喘息发作病史，肺功能明显降低，支气管舒张试验阳性，这些症状提示支气管哮喘。呼吸困难，大汗淋漓，三凹征，不能平卧，面色青灰，无哮鸣音，这些症状和体征提示支气管哮喘急性发作为危重状态。使用吸入型速效β2受体激动剂可以舒张支气管，缓解哮喘症状（A对）。必要时辅助以机械通气用于哮喘危重状态的治疗（B对）。使用吸入型糖皮质激素不能用于哮喘危重状态的治疗，因为哮喘危重状态是要全身应用糖皮质激素，而不是用吸入治疗（C错，为本题正确答案）。氧疗可改善可以改善患儿低氧血症，因此可以用于该患儿的治疗（D对）。补液纠正酸中毒用于哮喘危重状态的治疗（E对）。